制订地面水水质卫生标准的原则是
A. 防止地面水传播疾病
B. 防止地面水引起急、慢性中毒及远期效应
C. 保证地面水感官性状良好
D. 选用最敏感指标
E. 以上都是

正确答案：E。以上都是

解析：本题考查制订地面水水质卫生标准的原则。制订地面水水质卫生标准的原则是：防止地面水传播疾病；防止地面水引起急、慢性中毒及远期效应；保证地面水感官性状良好；选用最敏感指标（E对ABCD错）。